寒包火证属于八纲证候间的关系是
A. 寒证转热证
B. 热证转寒证
C. 真热假寒证
D. 真寒假热证
E. 寒热错杂证

正确答案：E。寒热错杂证

解析：寒热错杂包括表寒里热与表热里寒；上下的寒热错杂包括上热下寒及上寒下热，“寒包火”证属于表寒里热，是寒热错杂证（E对）。寒证化热指原为寒证，后出现热证，而寒证随之消失（A错）。热证转寒指原为热证，后出现寒证，而热证随之消失（B错）。真热假寒证是指疾病的本质为热证，却出现某些“寒象”的表现，又称“热极似寒”（C错）。真寒假热证是指疾病的本质为寒证，却出现某些“热象”的表现，又称“寒极似热”（D错）。